+），松（-）。X线示右上Ⅳ深龋近髓，根尖周未见异常。诊断是
A. 牙髓坏死
B. 急性牙髓炎
C. 急性根尖周炎
D. 急性牙周炎
E. 急性冠周炎

正确答案：B。急性牙髓炎

解析：本题考查不可复性牙髓炎-急性牙髓炎。涂某，男，4岁7个月。右上后牙疼痛1天，昨晚疼痛加剧，影响睡眠，未经治疗。检查：右上Ⅳ远中邻面龋，内有食物残渣，探（+ + +），叩（±），冷（+ +），松（-）。X线示右上Ⅳ深龋近髓，根尖周未见异常。诊断是急性牙髓炎（B对）。根据题目中的信息右上后牙疼痛1天，昨晚疼痛加剧，影响睡眠，可诊断为急性牙髓炎。牙髓坏死一般无自觉症状，牙冠变色，牙髓电活力测验无反应，冷热刺激无反应（A错）。急性根尖周炎叩痛明显，夜间不会加剧疼痛（C错）。急性牙周炎叩痛明显，牙齿有松动（D错）。急性冠周炎，牙冠萌出或不全阻生时，牙冠周围软组织发生的炎症，相邻Ⅳ可有叩击痛，有时Ⅳ远中颈部可因阻生牙等导致局部龋坏，并非Ⅳ（E错）。